男，72岁。脑血管病患者。住院期间突然半夜起床活动。无目的地摸床，摸墙，摸病友的头，自语，白天安静入睡。下列最有意义的检查是
A. CT检查
B. MRI检查
C. 脑电图
D. 超声检查
E. SPET-CT检查

正确答案：B。MRI检查

解析：患者为老年男性，有脑血管病史，突发精神神智异常症状。考虑诊断为血管性痴呆。血管性痴呆患者的明确诊断除了病史和临床表现外，还可通过MRI检查（B对）判断脑血管及脑组织梗死部位。CT检查（A错）效果不如MRI。脑电图（C错）主要用于癫痫等有痫性发作的疾病的诊断。超声检查（D错）对判断脑组织的损害情况意义不大。SPETCT检查（E错）主要用于骨骼显像的早期恶性肿瘤骨转移。